测定生命质量的常用工具不包括
A. Torrance健康状态分类系统
B. McMaster健康指数
C. Geller-Gesner表
D. 疾病影响量表
E. 诺丁汉健康量表

正确答案：C。Geller-Gesner表

解析：本题考查测定生命质量的常用工具。测定生命质量的常用工具包括：Torrance健康状态分类系统（A对）、McMaster健康指数（B对）、疾病影响量表（D对）、诺丁汉健康量表（E对），不包括Geller-Gesner表（C错，为本题正确答案）。